用于抗艾滋病病毒的药物是
A. 利巴韦林
B. 扎那米韦
C. 齐多夫定
D. 阿昔洛韦
E. 碘苷

正确答案：C。齐多夫定

解析：本题考查抗艾滋病病毒药。用于抗艾滋病病毒的药物是齐多夫定（C对）。齐多夫定为脱氧胸苷衍生物，是第一个上市的抗HIV药，也是治疗AIDS的首选药。利巴韦林（A错）和扎那米韦（B错）为抗流感病毒药。阿昔洛韦（D错）和碘苷（E错）为抗疱疹病毒药。